男，70岁。被诊断为抑郁障碍。某天得知其一位老朋友是心理治疗师，心想熟人好办事，遂向其求助，但却遭到了拒绝。该心理治疗师拒绝提供服务所依据的心理治疗原则为
A. 真诚
B. 耐心
C. 回避
D. 中立
E. 保密

正确答案：C。回避

解析：该心理治疗师拒绝提供服务所依据的心理治疗原则为回避原则（C对），回避原则指的是医护人员不能为本人及近亲属进行治疗或者进行与本人及近亲属有利害关系的相关治疗。